结节性甲状腺肿的病理特点是
A. 滤泡上皮高柱状
B. 滤泡上皮增生与复旧不—致
C. 结节边界清楚、包膜完整
D. 滤泡小而一致
E. 结节常为囊性变

正确答案：B。滤泡上皮增生与复旧不—致

解析：结节性甲状腺肿的病理特点是：滤泡上皮局灶性增生、复旧或萎缩不一致（B对），部分滤泡上皮呈柱状或乳头样增生（A错），小滤泡形成，结节大小不等，有的结节境界清楚，常无完整包膜（C错），切面内常见出血、坏死、囊性变（E错）、钙化和疤痕形成。